迷走神经的耳廓凹面躯体感觉纤维中枢支终止于
A. 下涎核
B. 迷走神经背核
C. 三叉神经脊束核
D. 疑核
E. 孤束核

正确答案：C。三叉神经脊束核

解析：迷走神经为混合性神经，其一般躯体感觉纤维的周围突分布于外耳道、耳廓凹面，中枢支终止于三叉神经脊束核（C对），其一般内脏感觉纤维中枢突止于孤束核（E错），其特殊内脏运动纤维起自疑核（D错），其副交感纤维起自迷走神经背核（B错）。舌咽神经的副交感纤维起自下泌涎核（A错）。